某女，40岁，感冒后下唇及唇周皮肤出现成簇的针头大小的水疱，破溃后结痂，局部灼痒疼痛。患者可能患有的疾病为
A. 唇疱疹
B. 慢性唇炎
C. 疱疹性口炎
D. 固定性药疹
E. 复发性口疮

正确答案：A。唇疱疹

解析：本题考查单纯疱疹-复发性疱疹性口炎。某女，40岁，感冒后下唇及唇周皮肤出现成簇的针头大小的水疱，破溃后结痂，局部灼痒疼痛。患者可能患有的疾病为唇疱疹（A对）。患者于下唇及唇周皮肤出现成簇的针头大小的水疱，破溃结痂，局部灼痒疼痛，符合唇疱疹的病变特点，唇疱疹可因感冒引起，病损区可有刺激痛、灼痛、痒、张力增加等症状，大约在10多个小时内出现水疱，周围有轻度红斑，疱持续24小时后，破裂，接着是糜烂、结痂。慢性唇炎（B错）病后才能反复，时轻时重，寒冷干燥季节好发，唇红反复干燥、脱屑、痛胀痒、渗出结痂。疱疹性口炎（C错）以6岁以下儿童多见，水疱可发生于口腔任何部位。固定性药疹（D错）表现为局部灼热发痒，有暗红色斑，呈圆形或椭圆形，边缘清楚，发病前有用药史。复发性口疮（E错）表现为反复发作的圆形或椭圆形溃疡，具有红黄凹痛的临床特征，具有周期性、复发性及自愈性。